关于上颌第一前磨牙与下颌第一前磨牙解剖的相同之处，说法错误的是
A. 颊面的外形高点均位于颈1/3处
B. 舌面的外形高点均位于舌面中1/3处
C. 邻面的近远中接触区均靠（牙合）缘偏颊侧
D. 牙根均为双根
E. （牙合）面均为颊侧宽于舌侧

正确答案：D。牙根均为双根

解析：本题考查牙体解剖外形及异同点。牙根均为双根（D错，为本题正确答案）不符合上颌第一前磨牙与下颌第一前磨牙解剖的相同之处，上颌第一前磨牙多数在根中部或根尖1/3处分叉为颊，舌两根，下颌第一前磨牙为扁而细长的单根。上颌第一前磨牙与下颌第一前磨牙解剖的相同之处有颊面的外形高点均位于颈1/3处（A对）；舌面的外形高点均位于舌面中1/3处（B对）；邻面的近远中接触区均靠(牙合)缘偏颊侧（C对）；（牙合）面均为颊侧宽于舌侧（E对）。